血虚便秘证，阴血已复，便仍干燥，治疗应首选
A. 黄芪汤
B. 增液汤
C. 润肠丸
D. 五仁丸
E. 青麟丸

正确答案：D。五仁丸

解析：黄芪汤功能益气润肠，为治疗气虚秘的选方（A错）。增液汤功能滋阴通便，为治疗阴虚秘的选方（B错）。润肠丸功能养血润燥，为治疗血虚秘的选方（C错）。血虚秘若阴血已复，便仍干燥，则为肠腑干燥，润燥即可，选用润滑肠道的五仁丸（D对）。便秘热秘若燥热不甚，或药后大便不爽者，方选青麟丸（E错）。